女，52岁，停经两年，阴道流血十天。既往有高血压，糖尿病史。查体：阴道及宫颈未见异常，子宫体稍增大。检查：子宫内膜厚1.1cm，血流增强。为明确诊断，进一步的检查
A. CEA125
B. 分段诊刮
C. 宫颈细胞学检查
D. 宫腔镜
E. 阴道镜

正确答案：B。分段诊刮

解析：患者女，52岁，停经两年，阴道流血十天（子宫内膜癌的表现）。既往有高血压，糖尿病史（子宫内膜癌发病的相关因素）。查体：阴道及宫颈未见异常，子宫体稍增大（子宫内膜癌的体征）。检查：子宫内膜厚1.1cm，血流增强。结合患者的病史，表现和辅助检查，为明确诊断，进一步应行分段诊刮的检查（B对）。（P309）血清 CA125测定：有子宫外转移者或浆液性癌，血清125值升高可作为疗效观察的指标（A错）。（P309）子宫内膜微量组织学或细胞学检查操作方法简便，国外文献报道其诊断的准确性与诊断性刮宫相当（C错）。宫腔镜检查可直接观察宫腔及宫颈管有无癌灶存在，癌灶大小及部位，直视下活检，对局灶型子宫内膜癌的诊断和估计宫颈是否受侵更为准确（D错）。（P434）阴道镜检查也用于外阴、会阴体及肛周皮肤相应病变的观察（E错）。